申请输血应由谁填写临床输血申请书
A. 主治医师
B. 经治医师
C. 主任医师
D. 住院医师
E. 副主任医师

正确答案：B。经治医师

解析：申请输血应由经治医师逐项填写《临床输血申请单》，由主治医师核准签字，连同受血者血样于预定输血日期前送交输血科（血库）备血。掌握“医疗机构临床用血管理、及法律责任”知识点。